诊断胰岛素瘤最准确的方法是
A. Wipple三联征
B. 血糖空腹时2.2mmol/L
C. 葡萄糖耐量试验
D. 饥饿试验
E. 血胰岛素测定

正确答案：E。血胰岛素测定

解析：胰岛素瘤是胰岛B细胞来源的肿瘤，由于B细胞可分泌大量胰岛素，因此患者常表现为一系列的低血糖症状。应用放免方法进行血胰岛素测定（E对），以及获得血中胰岛素相对于血糖水平而言异常增高的证据，直接支持胰岛素瘤的诊断。经典的Whipple三联症（A错）对诊断胰岛素瘤具有重要价值，但临床上并不是所有的胰岛素瘤患者均会有典型的表现。血糖空腹时2.2mmol/L（B错）可见于内、外源性高胰岛素血症、升糖激素缺乏或不足或某些重症疾病（肝肾衰竭、脓毒血症、营养不良等），临床上多由饮酒和药物引起。葡萄糖耐量试验（C错）用于诊断糖尿病。作饥饿试验时，胰岛素瘤患者较正常人更容易发作低血糖。因而饥饿试验（D错）可协助胰岛素瘤的诊断，但特异性不如胰岛素测定。